某男，62岁。阳痿不举，失眠多梦，神疲乏力，食少纳呆，腹胀便溏；舌苔薄白，脉细弱。宜采用的治法是
A. 温肾助阳
B. 益肾宁神
C. 疏肝解郁
D. 补肾疏肝
E. 补益心脾

正确答案：E。补益心脾

解析：本题考查的是阳痿的辨证论治。某男，62岁。阳痿不举，失眠多梦，神疲乏力，食少纳呆，腹胀便溏；舌苔薄白，脉细弱。宜采用的治法是补益心脾（E对）。阳痿是指男性除未发育成熟或已到性欲衰退期外，性交时阴茎不能勃起，或虽勃起但勃起不坚，或勃起不能维持，以致不能进行或完成性交全过程的疾病。西医学中勃起功能障碍表现为上述症状者，可参考此内容辨证论治。（一）惊恐伤肾证：【症状】阳痿不振，伴心悸易惊，胆怯多疑，夜多噩梦，常有被惊吓史。舌苔薄白，脉弦细。【治法】益肾宁神（B错）。（二）心脾两虚证：【症状】阳痿不举；伴心悸，失眠多梦，神疲乏力，面色无华，食少纳呆，腹胀便溏。舌苔薄白，脉细弱。【治法】补益心脾。（三）肾阳不足证：【症状】阳事不举，或举而不坚，精薄清冷；伴神疲倦怠，形寒肢冷，阴部冷凉，面色无华，头晕耳鸣，腰膝酸软，小便清长。舌淡胖，苔薄白，脉沉细。【治法】温肾助阳（A错）。（四）肝郁不舒证：【症状】阳事不兴，或举而不坚；伴心情抑郁，胸胁胀满，善太息。舌苔薄白，脉弦。【治法】疏肝解郁（C错）。